可用于检查的杂质为：Ag-DDC法
A. 氯化物
B. 砷盐
C. 铁盐
D. 硫酸盐
E. 重金属

正确答案：B。砷盐